闭经虚证的发病机制是
A. 多产房劳或久病伤肾
B. 血海空虚，无血可下
C. 脾胃虚弱，化源不足
D. 思虑过度，损伤心脾
E. 素体阴虚或久病伤血

正确答案：B。血海空虚，无血可下

解析：素体气血不足或思虑、饮食损伤脾胃，生化不足，营血亏虚；或大出血，久病大便，耗伤气血，以致肝肾失养、冲任不充，血海亏虚，无血可下而闭经或先天不足、精气未充、天癸亏乏不能应时泌至则冲任不盛、任脉不通而闭经或素体阴血不足，或失血伤阴，或久病耗阴，津液即绝，血海枯竭而闭经（B对）。多产房劳，房事不节，日久伤及肾气，冲任亏虚，血海亏虚，无血可下，发为闭经，多产房劳或久病伤肾为闭经虚证的其中一个闭经（A错）。脾胃虚弱，生化不足，营血亏虚致血海亏虚，无血可下，发为闭经，脾胃虚弱，化源不足为闭经虚证的其中一个闭经（C错）。思虑伤脾，脾气亏虚，生化不足，营血亏虚致血海亏虚，无血可下，发为闭经，思虑过度，损伤心脾为闭经虚证的其中一个闭经（D错）。素体阴血亏虚，虚火上炎，火逼水涸，津液不生，血海枯竭发为闭经，素体阴虚或久病伤血为闭经虚证的其中一个闭经（E错）。